为了很快达到稳态血药浓度,采取的给药方法是
A. 药物恒速静脉滴注
B. 一个半衰期口服给药一次时,首剂加倍
C. 一个半衰期口服给药一次时，首剂用1倍的剂量
D. 每五个半衰期给药一次
E. 每五个半装期增加给药一次

正确答案：B。一个半衰期口服给药一次时,首剂加倍